硝酸甘油抗心绞痛的主要机理是
A. 选择性扩张冠脉，增加心肌供血
B. 阻断β受体，降低心肌耗氧量
C. 减慢心率、降低心肌耗氧量
D. 扩张动脉和静脉，降低耗氧量；扩张冠状动脉和侧支血管，改善局部缺血
E. 抑制心肌收缩力，降低心肌耗氧量

正确答案：D。扩张动脉和静脉，降低耗氧量；扩张冠状动脉和侧支血管，改善局部缺血

解析：本题考查硝酸甘油。硝酸甘油抗心绞痛的主要机理是扩张动脉和静脉，降低耗氧量；扩张冠状动脉和侧支血管，改善局部缺血（D对）。硝酸甘油进入平滑肌细胞后可分解产生NO，增加cGMP的生成，使钙离子从细胞释放而松弛平滑肌；扩张冠状动脉和侧支循环血管，增加缺血区域的血流供应，缓解心绞痛。